药品名称“盐酸小檗碱”属于
A. 注册商标
B. 商品名
C. 品牌名
D. 通用名
E. 别名

正确答案：D。通用名

解析：本题考查药物的名称。药品名称“盐酸小檗碱”属于通用名（D对）。药物的名称包括药物的通用名，化学名和商品名。药品通用名也称为国际非专利药品名称（INN），通常是指有活性的药物物质，而不是最终的药品，因此是药学研究人员和医务人员使用的共同名称，如西咪替丁是甲氰咪胍的通用名。商品名，又称为品牌名（C错），是由新药开发者在申报药品上市时选定的。药品的商品名（B错）通常是针对药物的最终产品，即剂量和剂型已确定的含有一种或多种药物活性成分的药物。有些药物的名称因常被应用，可称之为该药的别名（E错）或习用名，如先锋4号是头孢氨苄的习用名等。